吗啡
A. 可引起瞳孔扩大
B. 可引起呼吸抑制
C. 可引起共济失调
D. 可引起急性心力衰竭
E. 可引起再生障碍性贫血

正确答案：B。可引起呼吸抑制

解析：吗啡属于菲类生物碱，具有强大的镇痛作用，可支配瞳孔的副交感神经，引起瞳孔缩小（A错），对心率及节律均无明显影响，且能扩张血管，降低外周阻力，故很少引起急性心力衰竭（D错），在治疗剂量就可以出现呼吸抑制（B对），使呼吸频率减慢、潮气量降低、每分通气量减少，其中呼吸频率减慢尤为突出，并随剂量增加而作用增强，是吗啡急性中毒致死的主要原因。可引起共济失调（C错）、可引起再生障碍性贫血（E错）均不是吗啡的副作用。